桔梗治疗咳嗽痰多，其机理是
A. 降气消痰
B. 燥湿祛痰
C. 清肺化痰
D. 宣肺祛痰
E. 泻肺化痰

正确答案：D。宣肺祛痰

解析：桔梗能宣肺，祛痰，利咽，排脓。咳嗽的病机总因邪犯于肺，肺气壅遏不畅，应治以宣肺止咳，痰多应治以祛痰利咽，因此治疗痰多咳嗽当以宣肺祛痰（D对）。